悬钟穴位于
A. 外踝后缘中点上3寸，腓骨前缘
B. 外踝前缘中点上3寸，腓骨前缘
C. 外踝下缘中点上3寸，腓骨前缘
D. 外踝高点上3寸，腓骨前缘
E. 外踝上缘中点上3寸，腓骨前缘

正确答案：D。外踝高点上3寸，腓骨前缘

解析：该题考察腧穴的定位，关于腧穴定位的相关体表解剖标志及骨度分寸要牢记，避免混淆。悬钟为足少阳胆经腧，位于外踝高点上3寸，腓骨前缘（D对）。